患者女，41岁，G2P1，诊断为葡萄胎，子宫超过孕14周大，首选的治疗措施是
A. 化疗
B. 先化疗再清宫
C. 清除宫腔内容物
D. 手术切除子宫
E. 先清宫，再切除子宫

正确答案：E。先清宫，再切除子宫

解析：葡萄胎随时有大出血可能，且葡萄胎虽是良性疾患，但仍有潜在的恶性变。15%～20%的葡萄胎有恶性变的可能，40岁以上的妇女患葡萄胎后发生恶变者较年轻妇女高4～6倍。若子宫超过孕14周大小应考虑先吸出葡萄胎组织再切除子宫，所以需要先清宫，再切除子宫（CD错E对）；有高危因素（年龄>40岁、子宫明显大于停经月份，血βHCG值异常升高、滋养细胞高度增生或伴不典型增生、清宫后血β-HCG不呈进行性下降或始终处于高值且排除葡萄胎残留、有咯血等），以及出现可疑转移灶和随访困难的患者，预防性化疗的时机，尽可能选在清宫前或清宫时。预防性化疗不能代替随访。部分性葡萄胎一般不行预防性化疗（AB错）。